可抑制鲨烯环氧酶的活性，属于丙烯胺类抗皮肤真菌药的是
A. 制霉菌素
B. 联苯苄唑
C. 特比萘芬
D. 阿莫罗芬
E. 环吡酮胺

正确答案：C。特比萘芬

解析：本题考查特比萘芬。可抑制鲨烯环氧酶的活性，属于丙烯胺类抗皮肤真菌药的是特比萘芬（C对）。丙烯胺类包括萘替芬和特比萘芬，为角鲨烯环氧酶的非竞争性、可逆性抑制剂。制霉菌素（A错）为抗生素类抗真菌药。联苯苄唑（B错）为咪唑类抗真菌药。阿莫罗芬（D错）为吗啉类抗真菌药。环吡酮胺（E错）为吡啶酮类抗真菌药。